根据不同国家、不同年代、不同民族调查，均发现同卵双生者精神分裂症的发病率显著高于异卵双生者的发病率。此结果表明
A. 此病主要与遗传有关
B. 此病主要与环境有关
C. 此病主要与生活习惯有关
D. 此病病因遗传与环境同等重要
E. 此病病因遗传与生活习惯、环境同等重要

正确答案：A。此病主要与遗传有关